常见的药酶诱导剂有
A. 苯巴比妥
B. 水合氯醛
C. 苯妥英钠
D. 利福平
E. 以上都是

正确答案：E。以上都是